鉴定破伤风杆菌有无致病性最可靠依据是
A. G+杆菌
B. 菌体顶端有圆形芽胞
C. 产生痉挛毒素
D. 专性厌氧
E. 有周鞭毛

正确答案：C。产生痉挛毒素